属于超短效的胰岛素制剂是
A. 甘精胰岛素
B. 低精蛋白锌胰岛素
C. 赖脯胰岛素
D. 精蛋白锌胰岛素
E. 普通胰岛素

正确答案：C。赖脯胰岛素

解析：本题考查胰岛素制剂的种类及特点。属于超短效的胰岛素制剂是赖脯胰岛素（C对）。甘精胰岛素（A错）属于超长效的胰岛素制剂。低精蛋白锌胰岛素（B错）属于中效的胰岛素制剂。精蛋白锌胰岛素（D错）属于长效的胰岛素制剂。普通胰岛素（E错）属于短效的胰岛素制剂。